男，18岁。因寒战，发热，咽痛来诊。经检查：体温39℃，双侧扁桃体肿大Ⅱ度，断为急性扁桃体炎，决定用青霉素。青霉素皮试（-）。但注射青霉素后，病人突感头晕，呕吐，全身湿冷，面色苍白，血压已测不到，此时该用何药抢救
A. 去甲肾上腺素
B. 多巴胺
C. 肾上腺素
D. 间羟胺
E. 山莨菪碱

正确答案：C。肾上腺素

解析：肾上腺素用于心脏骤停的抢救和过敏性休克的抢救，也可用于其他过敏性疾病（如支气管哮喘、荨麻疹）的治疗。与局麻药合用有利局部止血和延长药效。掌握“肾上腺素”知识点。